随机选择2岁组儿童1000名作预防某病的免疫接种试验，观察十年，结果80%免疫接种者未得病，因此，得出免疫效应的结论是
A. 这个疫苗是优良的，因有较高的免疫率
B. 无结论可言，因从开始就无相应的对照组
C. 无结论可言，因从开始就没有显著性检验
D. 这个疫苗没有很好的效果，因它未产生较高免疫率
E. 疾病发生率为100%－80%＝20%

正确答案：B。无结论可言，因从开始就无相应的对照组

解析：本题考查队列研究的实际应用。队列研究通过直接观察某因素不同暴露状况人群的结局来探讨该因素与所观察结局的关系，对照组时队列研究的重要因素。本题试验对注射疫苗的暴露组进行随访，而没有对不接种儿童进行追踪观察，因此试验不够严谨，无法得出有意义的结论（B对ACDE错）。